牙尖过高等牙齿形态异常，干扰了正常咬合关系，牙周治疗时对此常采用的治疗方法为
A. 口腔卫生宣教
B. 洁治
C. 刮治
D. 调（牙合）
E. 牙周手术

正确答案：D。调（牙合）

解析：本题考查（牙合）治疗。牙尖过高等牙齿形态异常，干扰了正常咬合关系，牙周治疗时对此常采用的治疗方法为调（牙合）（D对）。采用调（牙合）将过高的牙尖磨除，可消除（牙合）干扰，恢复正常的咬合关系。口腔卫生宣教（A错）对于因菌斑牙石引起的龋病、牙周病的防治有一定效果；洁治（B错）是为了去除龈上牙石、菌斑和色渍；刮治（C错）是为了去除牙周袋内根面上的牙石菌斑；牙周手术（E错）是在基础治疗后，仍有5mm以上牙周袋，且探诊出血，或牙龈及骨形态不良、膜龈关系不正常时，采用的治疗方法；这些治疗方法对于牙尖过高引起的（牙合）干扰没有治疗作用。